关于热原性质的错误表述是
A. 耐热性
B. 滤过性
C. 光不稳定性
D. 不挥发性
E. 水溶性

正确答案：C。光不稳定性

解析：本题考查热原的性质。光不稳定性（C错，为本题正确答案）不属于热原的性质。热原的性质：（1）水溶性（E对）；（2）不挥发性（D对）；（3）耐热性（A对）；（4）过滤性（B对）；（5）其他性质。热原能被强酸、强碱、强氧化剂如高锰酸钾、过氧化氢以及超声波破坏。热原在水溶液中带有电荷，也可被某些离子交换树脂所吸附。